小便不利，自下利，腹中痛者，宜用
A. 真武汤
B. 茵陈蒿汤
C. 柴胡加龙骨牡蛎汤
D. 猪苓汤
E. 小柴胡去黄芩加茯苓汤

正确答案：A。真武汤

解析：少阴病二三日不已，至四五日，邪气递深，肾阳日衰，阳虚寒盛，制水无权，可致水气不化，泛溢为患。水泛上焦，寒水犯肺，肺气上逆，则见咳嗽；水泛中焦，寒水犯胃，胃气上逆则呕吐；水饮内渍于肠，则腹痛下利；水停下焦。阳虚气化不行，则见小便不利；水泛肌表浸淫肢体，则见四肢沉重、疼痛。水饮内停，变动不居，内而脏腑，外而四肢，上中下三焦，无处不到，见症虽多，但总属肾阳虚衰兼水气为患，故用真武汤主治（A对）。